下列哪种情况可拔除松动牙
A. 牙槽骨吸收达到根1/3以上，牙松动达Ⅰ度者
B. 牙槽骨吸收达到根1/4以上，牙松动达Ⅰ度者
C. 牙槽骨吸收达到根2/3以上，牙松动达Ⅱ度者
D. 牙槽骨吸收达到根1/4以上，牙松动达Ⅱ度者
E. 牙槽骨吸收达到根2/3以上，牙松动达Ⅲ度者

正确答案：E。牙槽骨吸收达到根2/3以上，牙松动达Ⅲ度者

解析：本题考查修复前准备。一般来说，对于牙槽骨吸收达到根2/3以上，牙松动达Ⅲ度者（E对）应拔除；对未达到这一严重程度的松动牙，经有效治疗后尽量予以保留。